下列选项中对伤害分布特征描述正确的是
A. 总体上发达国家的伤害死亡高于发展中国家
B. 儿童、青少年伤害死亡呈下降趋势
C. 伤害死亡中男性比例低于女性
D. 发达国家的职业性伤害和道路交通伤害的发生有逐渐上升的趋势
E. 交通事故是我国农村地区伤害死亡的首要原因

正确答案：E。交通事故是我国农村地区伤害死亡的首要原因

解析：本题考查伤害的相关内容。总体上发达国家的伤害死亡要低于发展中国家（A错）；儿童、青少年伤害死亡呈上升趋势（B错）；伤害死亡中男性比例要高于女性（C错）；发达国家的职业性伤害和道路交通伤害的发生有逐步下降的趋势（D错）；交通事故是我国农村地区伤害死亡的首要原因（E对）。